关于压片药料制颗粒目的的叙述，正确的有
A. 增加物料的流动性，使片重和含量准确
B. 加速片剂中有效成分的溶出，提高疗效
C. 避免粉末分层，保证片剂均匀性
D. 避免粉末飞扬及黏冲、拉模等现象
E. 缩小体积、减少服用剂量

正确答案：A、C、D。增加物料的流动性，使片重和含量准确；避免粉末分层，保证片剂均匀性；避免粉末飞扬及黏冲、拉模等现象